联苯胺引起的法定职业肿瘤为
A. 肾脏肿瘤
B. 肺脏肿瘤
C. 白血病
D. 脑瘤
E. 膀胱癌

正确答案：E。膀胱癌

解析：本题考查联苯胺的致癌种类。联苯胺引起的法定职业肿瘤为膀胱癌（E对ABCD错）。高危职业有：生产萘胺、联苯胺和4-氨基联苯的化工行业；以萘胺、联苯胺为原料的染料、橡胶添加剂、颜料等制造业；使用芳香胺衍生物作为添加剂的电缆、电线行业等。